炎症的基本病理变化是
A. 变性、坏死、增生
B. 萎缩、渗出、增生
C. 增生、坏死、纤维化
D. 萎缩、变性、坏死
E. 变质、渗出、增生

正确答案：E。变质、渗出、增生

解析：炎症的基本病理变化为局部组织变质、渗出、增生（E对）。